最常用的超临界流体是
A. 水
B. 甲醇
C. 二氧化碳
D. 三氧化二铝
E. 二氧化硅

正确答案：C。二氧化碳

解析：本题考查的是中药成分提取中的超临界流体萃取法。最常用的超临界流体是二氧化碳（C对）。超临界流体萃取法：是采用超临界流体为溶剂对中药材进行萃取的方法。已知可作为超临界流体的物质很多，如二氧化碳、一氧化二氮、六氟化硫、乙烷、庚烷、氨、二氯二氟甲烷等，其中以二氧化碳最为常用。